前腭突与上颌突未能联合或者部分联合，则形成
A. 腭裂
B. 上颌裂
C. 下颌裂
D. 上唇裂
E. 下唇裂

正确答案：B。上颌裂

解析：上颌裂为前腭突与上颌突未能联合或部分联合所致。掌握“腭部与舌的发育”知识点。